整合在宿主菌染色体上的是
A. 染色体
B. 质粒
C. 毒力岛
D. 转座子
E. 前噬菌体

正确答案：E。前噬菌体